化纤衣服可能引起心律失常，其原因可能与下列哪项有关
A. 静电感应
B. 透气性
C. 吸汗性能
D. 细菌繁殖
E. 重金属污染

正确答案：A。静电感应

解析：本题考查化纤衣服引起心律失常的原因。化纤衣服静电感应（A对BCDE错）严重，静电干扰可改变体表电位差，使心脏电传导改变，引起心律失常。